每40cm²肌肉上检查出囊尾蚴5个，该肉应该
A. 销毁
B. 工业用
C. 冷冻处理
D. 盐腌
E. 高温处理

正确答案：E。高温处理